关于微囊技术的说法错误的是
A. 将对光、湿度和氧不稳定的药物制成微囊，可防止药物降解
B. 利用缓释材料将药物微囊化后，可延缓药物释放
C. 油类药物或挥发性药物不适宜制成微囊
D. PLA是可生物降解的高分子囊材
E. 将不同药物分别包囊后，可减少药物之间的配伍变化

正确答案：C。油类药物或挥发性药物不适宜制成微囊

解析：本题考查微囊技术。关于微囊技术的说法错误的是油类药物或挥发性药物不适宜制成微囊（C错，为本题正确答案）。鱼肝油等药物制成微囊化制剂后，可以有效地掩盖药物的不良臭味。如易氧化药物β－胡萝卜素、易水解药物阿司匹林，制成微囊化制剂后能够在一定程度上避免光线、湿度和氧的影响，防止药物的分解，提高药物的化学稳定性（A对）。用缓释、控释微囊化材料将药物制成微囊后，可以延缓药物的释放，延长药物作用时间，达到长效目的，如复方甲地孕酮微囊注射剂、美西律微囊骨架片等（B对）。聚乳酸（PLA）和丙交酯乙交酯共聚物（PLGA）是被 FDA 批准的可降解高分子囊材（D对）。将不同药物分别包囊后，可减少药物之间的配伍变化（E对）。如阿司匹林与氯苯那敏配伍后阿司匹林的降解加速，分别包囊后可以避免这种配伍变化。